与外毒素性质的叙述，不符合的是
A. 主要的化学成分是蛋白质
B. 细菌生活状态下释放
C. 耐热、性质稳定
D. 毒性强
E. 抗原性强

正确答案：C。耐热、性质稳定

解析：掌握“医院感染及细菌的致病性”知识点。